慢性肾衰出现下列情况，需要紧急透析治疗的是
A. 血肌酐700μmol/L
B. 血钾6.8mmol/L
C. 血红蛋白 72g/L
D. 血钠 130mmol/L
E. 血钙1.9mmol/L

正确答案：B。血钾6.8mmol/L

解析：慢性肾衰竭需要透析的指征包括：①血钾＞6.5mmol/L（正常值3.5～5.5mmol/L）（B对）；②有尿毒症的临床表现，血肌酐＞707.2umol/L（A错），GFR（肾小球滤过率）小于10ml/min或血尿素氮＞28.6mmol/L；③严重水、钠潴留，有肺水肿、脑水肿倾向；④严重酸中毒，pH＜7.2或HCO₃⁻＜12mmol/L；⑤药物或毒物中毒；⑥并发尿毒症性心包炎，消化道出血，中枢神经系统症状如神志恍惚、嗜睡、昏迷、抽搐，精神症状。